晚期梅毒是指
A. 一期梅毒
B. 二期梅毒
C. 三期梅毒
D. 四期梅毒
E. 隐性梅毒

正确答案：C。三期梅毒

解析：后天梅毒可分为一、二、三期及隐性梅毒。一、二期均属早期梅毒，多在感染后4年内出现症状，传染性强；三期梅毒又称晚期梅毒，系在感染4年后表现，一般无传染性。隐性梅毒指感染后除血清反应阳性外，无任何临床症状者。亦可按感染后4年为界分为早期和晚期。隐性梅毒可终生不出现症状，但也有早期无症状而晚期发病者。掌握“颌面部梅毒”知识点。